女婴，5个月。咳嗽伴发热三天，喘憋1天。无明显咳痰，体温波动在38℃～39℃，喘憋进行性加重。查体：T38.5℃，P150次/分，R60次/分，精神、反应可，双肺哮鸣音，双下肺可闻及细湿啰音，腹软，无明显压痛，肝肋下2cm。最可能的诊断是
A. 肺炎支原体肺炎
B. 呼吸道合胞病毒肺炎
C. 衣原体肺炎
D. 金黄色葡萄球菌肺炎
E. 腺病毒肺炎

正确答案：B。呼吸道合胞病毒肺炎

解析：女婴，5个月（1岁以内的儿童是呼吸道合胞病毒肺炎的多发人群）。咳嗽伴发热三天，喘憋1天。无明显咳痰，体温波动在38℃-39℃，喘憋进行性加重（较明显的呼吸困难、憋喘、低中度发热是呼吸道合胞病毒肺炎的典型临床表现）。查体：T38.5℃，P150次/分，R60次/分，精神、反应可，双肺哮鸣音，双下肺可闻及细湿啰音（肺部听诊有中、细湿啰音是呼吸道合胞病毒肺炎的临床体征），腹软，无明显压痛，肝肋下2cm。综上所述，该患者最有可能的诊断是呼吸道合胞病毒肺炎（B对），肺炎支原体肺炎（A错）病初有全身不适、乏力、头痛，2~3天后出现发热，体温常达39℃左右，持续1-3周，可伴有咽痛和肌肉酸痛。衣原体肺炎（C错）多见于学龄儿童，大部分为轻症发病常隐匿，早期为上呼吸道感染症状，咽痛、声音嘶哑、发热。金黄色葡萄球菌肺炎（D错）病变发展迅速，组织破坏严重，患儿面色苍白、烦躁不安、咳嗽、呻吟、呼吸浅快和发绀，重者可发生休克，腺病毒肺炎（E错）肺部湿啰音出现较晚，多于高热3~7天后才出现。